颧弓是由下列哪两个骨的部分相连而成
A. 颧骨颞突与上颌骨颧突
B. 颞骨颧突与颧骨眶下突
C. 颧骨颞突与颞骨颧突
D. 上颌骨颧突与颞骨颧突
E. 以上都不是

正确答案：C。颧骨颞突与颞骨颧突

解析：颞骨前下部有前伸的颧突，与颧骨的颞突构成颧弓（C对）。